男，25岁。腹痛、脓血便、发热2个月。大便10次/日，体温39℃。粪镜检及培养未见病原体。结肠镜检查示结肠弥漫分布的糜烂及浅溃疡。病理学提示重度慢性炎症。左氧氟沙星联合甲硝唑治疗1周症状无缓解。最适宜的治疗药物是
A. 泼尼松
B. 柳氮磺吡啶
C. 硫唑嘌呤
D. 美沙拉嗪
E. 美沙拉嗪联合美沙拉嗪栓

正确答案：A。泼尼松

解析：青年男性患者，有腹痛、脓血便、发热，大便10次/日（＞6次/日）。粪镜检及培养未见病原体，结肠镜检查示结肠弥漫分布的糜烂及浅溃疡，病理学提示重度慢性炎症。结合上述临床表现及实验室检查，溃疡性结肠炎（重度活动期）可能性大，应予泼尼松治疗（A对）。柳氮磺吡啶（B错）适用于轻、中度患者；巯唑嘌呤（C错）可用于对激素治疗效果不佳或缓解期患者；美沙拉嗪（D错）是由乙基纤维素包裹的5-氨基水杨酸，适用于轻、中度患者，其灌肠剂适用于病变局限在直肠及乙状结肠者，美沙拉嗪栓剂（E错）适用于病变局限在直肠者。